麻疹合并肺炎者应隔离至
A. 出疹后3天
B. 出疹后5天
C. 出疹后10天
D. 出疹后15天
E. 肺炎痊愈

正确答案：C。出疹后10天

解析：麻疹合并肺炎者应隔离至出疹后10天（C对），采取这样的措施可以更好的控制传染源，从而减少传染病的发病率。